甲状腺功能亢进症术前准备通常不包括
A. T₃，T₄测定
B. 喉镜检查
C. 控制心率
D. 给予氢化可的松
E. 测基础代谢率

正确答案：D。给予氢化可的松

解析：氢化可的松为糖皮质激素，可用于治疗术后甲状腺危象，但给予氢化可的松（D错，为本题正确答案）通常不用于甲状腺功能亢进症的术前准备。术前作T3，T4测定（A对）可用于了解甲亢是否得到控制，能否进行手术。术前作喉镜检查（B对），可确定声带功能，以鉴别术后声带功能受损是术中喉返神经损伤还是术前声带功能受损所致。甲亢手术须在甲亢症状基本控制的情况下方可进行，须满足病人情绪稳定，睡眠良好，体重增加，控制心率＜90次/分以下（C对），测定基础代谢率＜+20%（E对）。